肺炎链球菌的致病力主要来源于
A. 杀白细胞素
B. 血浆凝固酶
C. 外毒素
D. 荚膜侵袭力
E. 内毒素

正确答案：D。荚膜侵袭力

解析：肺炎链球菌的致病物质主要包括：荚膜、肺炎链球菌溶素O、脂磷壁酸和神经氨酸酶，其中肺炎链球菌的致病力主要来源于荚膜侵袭力（D对）。杀白细胞素（A错）是葡萄球菌的毒力因子，为葡萄球菌产生的毒素（P93表8-2）。血浆凝固酶（B错）是致病性葡萄球菌产生的侵袭性酶类，有利于抵抗宿主吞噬细胞的吞噬（P67）。外毒素（C错）是细菌合成并分泌（或释放）的毒性蛋白，许多革兰阳性菌和部分革兰阴性菌都可以产生，链球菌中A群链球菌有较强的侵袭力，可产生多种外毒素和胞外酶等（P98）。内毒素（E错）是产生于革兰阴性菌细胞壁的致病物质，化学成分为脂多糖（LPS）（P70），肺炎链球菌是革兰阳性菌。